月桂酸硫酸钠在牙膏中是
A. 胶黏剂
B. 润湿剂
C. 防腐剂
D. 摩擦剂
E. 洁净剂

正确答案：E。洁净剂

解析：本题考查牙膏的成分。月桂酸硫酸钠在牙膏中是洁净剂（E对）。牙膏中的洁净剂包括十二醇硫酸钠、脂肪硫醋钠、月桂醇硫酸酯钠盐、月桂酰肌氨酸钠、蔗糖脂肪酸酯；胶黏剂包括羧甲基纤维素、钠或镁铝硅酸盐复合体（A错）；润湿剂包括甘泊、山梨醇、丙二醇（B错）；防腐剂包括异氢氧安息香、对羟基苯甲酸酯类、三氯羟苯醚（C错）；摩擦剂包括碳酸钙、磷酸钙、不溶性偏磷酸钠、焦磷酸钙、二氧化硅等（D错）。